经络系统中，从十二正经中离入出合的是
A. 十二经脉
B. 十五络脉
C. 十二经别
D. 十二经筋
E. 十二皮部

正确答案：C。十二经别

解析：十二经脉是指十二脏腑所属的经脉，是经络系统的主体（A错）。十二经脉和任、督二脉各自别出一络，加上脾之大络，称为十五络脉。十二经脉的别络从本经四肢肘膝关节以下的络穴分出，走向其相表里的经脉。任督二脉的别络和脾之大络主要分布在头身部（B错）。十二经别是十二正经离、入、出、合的别行部分，是正经别行深入体腔的支脉（C对）。十二经筋是十二经脉之气输布于筋肉骨节的体系，是附属于十二经脉的筋肉系统（D错）。十二经脉是十二经脉功能活动反映于体表的部分，也是络脉之气散布之所在（E错）。